以下哪项不属口腔变态反应性疾病
A. Riga-Fede溃疡
B. 接触性口炎
C. 药物性口炎
D. 斯约综合征
E. 血管神经性水肿

正确答案：A。Riga-Fede溃疡

解析：本题考查口腔变态反应性疾病。Riga-Fede溃疡（A错，为本题正确答案）专指发生于儿童舌腹的创伤性溃疡。因过短的舌系带和过锐的新萌中切牙长期摩擦引起，舌系带处充血、肿胀、溃疡。久不治疗则转变为肉芽肿性溃疡，扪诊有坚韧感，影响舌活动。属于口腔黏膜溃疡类疾病。变态反应性疾病又叫超敏反应性疾病，是指机体受到某些抗原刺激后，出现生理功能或组织细胞损伤的异常适应性免疫应答，接触性口炎（B对），药物性口炎（C对），斯约综合征（D对），血管神经性水肿（E对）属于变态反应性疾病。